磷酸戊糖途径的主要产物之一是
A. NADPH
B. FMN
C. CoQ
D. cAMP
E. ATP

正确答案：A。NADPH

解析：磷酸戊糖途径在胞质中进行，分为两个阶段：第一阶段是氧化反应，生成磷酸核糖、NADPH和CO₂，第二个阶段是基团转移反应，最终生成果糖－６－磷酸和３－磷酸甘油醛。磷酸戊糖途径不能产生ATP，其主要意义是生成NADPH和磷酸核糖，这两种物质是肝、脂肪组织、哺乳期的乳腺、肾上腺皮质、性腺、骨髓和红细胞等组织发挥功能所需要的（A对），CoQ与FMN类似，能进行可逆的电子传递，参与氧化呼吸链的组成（BC错）。磷酸戊糖途径不能产生ATP（E错），cAMP作为第二信使参与信号转导（D错）。